淋巴器官不包括
A. 扁桃体
B. 淋巴结
C. 脾
D. 甲状腺
E. 胸腺

正确答案：D。甲状腺

解析：淋巴器官包括淋巴结（B对）、胸腺（E对）、脾（C对）和扁桃体（A对），甲状腺（D错，为本题正确答案）属于内分泌器官。